菟丝子的功效有
A. 益阴
B. 固精
C. 缩尿
D. 止泻
E. 明目

正确答案：A、B、C、D、E。益阴；固精；缩尿；止泻；明目

解析：本题考查的是菟丝子的功效。菟丝子的功效有益阴（A对）、固精（B对）、缩尿（C对）、止泻（D对）与明目（E对）。菟丝子：【功效】补阳益阴，固精缩尿，明目止泻，安胎，生津。